可引起巨幼红细胞性贫血的药物是
A. 氯喹
B. 奎宁
C. 伯氨喹
D. 乙胺嘧啶
E. 甲氟喹

正确答案：D。乙胺嘧啶

解析：乙胺嘧啶长期大量服用可能干扰人体叶酸代谢，引起巨幼红细胞性贫血、粒细胞性减少症等。掌握“氯喹、青蒿素、伯氨喹及乙胺嘧啶”知识点。